长期大量服用氯丙嗪出现帕金森综合征是由于
A. 阻断肾上腺素α受体
B. 阻断M胆碱受体
C. 阻断中脑-边缘系统和中脑-皮层系统的D2样受体
D. 阻断延脑第四脑室底部的催吐化学感受区的D2受体
E. 阻断了黑质-纹状体通路的D2样受体

正确答案：E。阻断了黑质-纹状体通路的D2样受体

解析：长期大量服用氯丙嗪可出现三种反应：①帕金森综合征；②静坐不能；③急性肌张力障碍。以上三种反应是由于氯丙嗪阻断了黑质-纹状体通路的D2样受体，使纹状体中的DA功能减弱、ACh的功能增强而引起的。掌握“氯丙嗪”知识点。